煮沸法消毒杀灭一般细菌所需时间为
A. 20分钟
B. 40分钟
C. 60分钟
D. 80分钟
E. 100分钟

正确答案：A。20分钟

解析：煮沸灭菌法适用于金属器械、玻璃制品及橡胶类物品等。在水中煮沸至100度，持续15～20分钟（A对），一般细菌即可被杀灭，但带芽孢的细菌至少需煮沸1小时才能被杀灭。